能引起四环素牙的药物有
A. 先锋霉素和四环素
B. 土霉素和去甲金霉素
C. 青霉素和缩水四环素
D. 链霉素和氯霉素
E. 洁霉素和庆大霉素

正确答案：B。土霉素和去甲金霉素

解析：本题考查四环素牙。能引起四环素牙的药物有去甲金霉素、土霉素、金霉素、四环素和米诺环素（B对）。先锋霉素（A错）为头孢菌素类抗生素，青霉素（C错）为青霉素类抗生素，链霉素（D错）和庆大霉素（E错）为氨基糖苷类抗生素，这四种药物均不会引起四环素牙。